银汞合金充填时，备洞要求除外
A. 需做成盒形洞
B. 有一定固位形状
C. 洞缘线圆钝
D. 点线角锐利
E. 去除无基悬釉

正确答案：D。点线角锐利

解析：本题考查银汞合金充填时的备洞要求。点线角应圆钝，避免应力集中使牙体组织折裂（D错，为本题的正确答案）。银汞合金充填时，由于银汞合金没有粘接性，窝洞需做成盒形洞以增加固位（A对）及牙齿的抗力。窝洞要有一定的固位形状，保证修复体能够获得足够的固位力（B对）。洞缘线圆钝可防止应力集中、充填体折断（C对）。无基釉为没有牙本质支持的釉质，易受力折断，备洞时应去除无基釉（E对）。